男性生殖器附属腺包括
A. 前列腺、尿道球腺
B. 输精管壶腹、精囊、前列腺
C. 附睾、前列腺、尿道球腺
D. 精囊、前列腺、尿道球腺
E. 无

正确答案：D。精囊、前列腺、尿道球腺

解析：精囊（A错）、前列腺、尿道球腺（D对）为男性生殖器附属腺。附睾（C错）、输精管（B错）为输精管道。